水体污染的调查根据调查的内容可分为
A. 基础调查
B. 监测性调查
C. 应急性调查
D. 专题调查
E. 以上都是

正确答案：E。以上都是

解析：本题考查水体污染的调查内容。水体污染调查可分为：①基础调查：目的是调查了解水体基本状况，调查范围较大，如全国性水体污染和某一水系的污染调查。②监测性调查：根据基础调查结果，选择代表性水体断面，定期对水污染进行调查，了解水体中污染物的变化情况。联合国环境规划署和世界卫生组织举办的全球监测系统的水质监测即属此类调查。③专题调查：为深入开展某类特定污染类型或污染物而 进行的针对性专门调查。④应急性突发事件调查（E对ABCD错）：在水体发生严重污染事故时对污染事故的原因、时间、可能造成的危害等情况进行的调查。